洋地黄中毒最常见的心电图表现是
A. 心房颤动
B. 室性期前收缩
C. 房性期前收缩
D. ST-T缺血性改变
E. 房室传导阻滞

正确答案：B。室性期前收缩

解析：洋地黄中毒最常见的心电图表现是室性期前收缩（B对），约占心脏毒性发生率的1/3，也可发生二联律，非阵发性交界区心动过速，房性期前收缩（C错），心房颤动（A错）及房室传导阻滞（E错）等。ST-T缺血性改变（D错）是心绞痛及心肌梗死的心电图表现。